下列中，不利于光化学烟雾形成的气象条件是
A. 气温高
B. 天气晴朗
C. 紫外线强烈
D. 风速小
E. 阴雨

正确答案：E。阴雨

解析：本题考查光化学烟雾形成的气象条件。光化学型烟雾事件发生季节多在夏秋季；发生时间多在中午或午后；气象条件多为气温高（A对）、风速很低（D对）、湿度较低、天气晴朗（B对）、紫外线强烈（C对）。阴雨（E错，为本题正确答案）不利于光化学烟雾形成。